便于观察复合树脂充填窝洞情况应首选
A. 瓷粉
B. 二氧化硅
C. 硅酸铝锂
D. 钡、锶玻璃粉

正确答案：D。钡、锶玻璃粉

解析：本题考查复合树脂的增强材料。钡、锶玻璃粉（D对）具有X线阻射性，用于复合树脂，可便于观察复合树脂的窝洞充填情况。瓷粉（A错）用来制作全瓷冠和烤瓷冠。二氧化硅（B错）、硅酸铝锂（C错）均是瓷粉的主要原料。